女性患者，38岁，因高热合并功能障碍前来就诊。家人叙述两天前做饭时将手部受伤，经过简单包扎后未做其他处理。检查时发现患者全身高热，呼吸急促，手部肿胀，皮肤呈现大理石花纹样，触诊可有捻发音，并有恶臭气味。则治疗时首选的药物是
A. 红霉素
B. 青霉素
C. 奥司他韦
D. 酮康唑
E. 万古霉素

正确答案：B。青霉素

解析：通过临床表现，考虑为气性坏疽梭状芽孢杆菌导致的气性坏疽，应用抗生素时应首选青霉素。掌握“特殊性感染”知识点。